药物经济学研究可用于
A. 指导新药研究生产
B. 指导新药质量标准制定
C. 制定医院用药目录
D. 指导制定医院制剂质量标准
E. 制定国家基本医疗保险药品目录

正确答案：A、C、E。指导新药研究生产；制定医院用药目录；制定国家基本医疗保险药品目录

解析：本题考查药物经济学研究的作用。药物经济学通过成本分析对比不同药物治疗方案或药物治疗方案与其他治疗方案的优劣，设计合理的临床药学服务方案，保证有限的社会卫生保健资源发挥最大的效用。可用于指导新药研究生产（A对）、制定医院用药目录（C对）、制定国家基本医疗保险药品目录（E对）。